医务人员为自己开具处方，骗取麻醉药品
A. 由其所在单位给予行政处分
B. 由公安机关依照治安管理处罚条例或有关规定给予处罚
C. 由司法机关追究刑事责任
D. 没收全部麻醉药品和非法收入，并视情节给予罚款等处罚
E. 以生产、贩卖毒品罪论处

正确答案：A。由其所在单位给予行政处分

解析：本题考查麻醉药品使用。医务人员为自己开具处方，骗取麻醉药品由其所在单位给予行政处分（A对）。根据《麻醉药品和精神药品管理条例》第七十三条第一款规定，具有麻醉药品和第一类精神药品处方资格的执业医师违反规定开具相关处方，或未按临床应用指导原则使用麻醉药品和第一类精神药品的，由其所在医疗机构取消其麻醉药品和第一类精神药品处方资格，造成严重后果的，由原发证机关吊销其执业证书。执业医师未按照临床应用指导原则的要求使用第二类精神药品或者未使用专用处方开具第二类精神药品，造成严重后果的，由原发证部门吊销其执业证书。